男，20岁。突发右侧胸痛伴气短1天入院。体检示右胸叩诊呈鼓音。该患者最可能出现的胸部X线片表现是
A. 膈疝
B. 气胸
C. 少量胸腔积液
D. 肺气肿
E. 巨大肺大泡

正确答案：B。气胸

解析：青年男性患者，突发右侧胸痛气短，体检示右胸叩诊呈鼓音，故该患者最可能出现的胸部X线片表现是气胸（B对）。膈疝（A错）可有胸痛、气短的表现，但叩诊不出现鼓音。少量胸腔积液（C错）在X线片有时可见，但不如气胸表现明显。肺气肿（D错）常为双侧，双肺叩诊呈过清音。巨大肺大疱（E错）可有胸闷、气短等症状，两者胸片均显示局部肺野透亮度增高，但气胸病人胸片透亮度更高，局部完全无肺纹理，且肺组织向肺门方向压缩，弧度与肺大疱相反。